患者，男性，35岁。左下第一磨牙拔除5个月，拟行种植义齿修复。如患者有以下哪种疾病时，不可进行牙种植术
A. 糖尿病伴发明显并发症
B. 口腔有牙龈、黏膜炎症
C. 骨硬化症
D. 口腔卫生较差
E. 以上均是

正确答案：E。以上均是

解析：牙种植术的禁忌症：①全身情况差或严重系统疾病不能承受手术者。②严重糖尿病，血糖过高或已有明显并发症者，因术后易造成感染，故应在糖尿病得到控制时方可手术。③口腔内有急、慢性炎症者，如牙龈、黏膜、上颌窦炎症等，应在治愈后手术。④口腔或颌骨内有良、恶性肿瘤者。⑤某些骨疾病，如骨质疏松症、骨软化症及骨硬化症等。⑥严重习惯性磨牙症。⑦口腔卫生不良者。⑧精神病患者。掌握“牙种植手术及效果评估”知识点。